表示食品受粪便近期污染的菌属是
A. 肠杆菌属
B. 埃希菌属
C. 柠檬酸菌属
D. 克雷伯菌属
E. 雷极菌属

正确答案：B。埃希菌属